上颌裂为
A. 颌突与侧鼻突未联合
B. 上下颌突未联合或部分联合
C. 侧腭突和鼻中隔未融合或部分融合
D. 前腭突与上颌突未能联合或部分联合所致
E. 一侧或两侧的球状突与上颌突未联合或部分联合所致

正确答案：D。前腭突与上颌突未能联合或部分联合所致

解析：颌裂：颌裂可发生于上颌，也可发生于下颌，但上颌裂常见。上颌裂为前腭突与上颌突未能联合或部分联合所致，常伴有唇裂或腭裂。下颌裂为两侧下颌突未联合或部分联合的结果，罕见。掌握“腭部与舌的发育”知识点。